2岁儿童在社区卫生服务中心进行生长监测，医生建议家长定期给孩子测量身长、体重，其每次间隔的时间是
A. 2个月
B. 3个月
C. 4个月
D. 5个月
E. 6个月

正确答案：B。3个月

解析：本题考查体格发育评价的相关内容。建议常规测量的时间及频率：＜6月龄的婴儿最好每月一次，6～12月龄每2个月一次，1～2岁每3个月一次（B对ACDE错），3～6岁每半年一次，6岁以上每年一次，高危儿童宜适当增加观察次数。